下列属于由内分泌疾病而引起尿量增多的原因是
A. 摄水过多
B. 急性肾衰多尿期
C. 应用利尿剂
D. 中枢性尿崩症
E. 慢性肾盂肾炎

正确答案：D。中枢性尿崩症

解析：中枢性尿崩症（D对）是指下丘脑视上核和室旁核分泌的抗利尿激素严重缺乏或部分缺乏引起多尿、烦渴、多饮与低比重尿和低渗尿为特征的一组综合征，属于因内分泌疾病导致的激素减少引起的尿量增多。摄水过多（A错）引起的尿量增多称为水利尿，为生理性尿量增多。急性肾衰多尿期（B错）肾小球滤过率恢复较快而肾小管重吸收恢复较慢所致；应用利尿剂（C错）可使肾小管的重吸收量减少、尿量增多，均无内分泌因素参与。慢性肾盂肾炎（E错）一般不会引起尿量增多。